胎盘附着部位的子宫内膜完全修复需到产后
A. 3周
B. 4周
C. 5周
D. 6周
E. 8周

正确答案：D。6周

解析：分娩后接近肌层的子宫内膜基底层，逐渐再生新的功能层，内膜缓慢修复，约于产后第3周（A错），除胎盘附着部位以外，宫腔表面均由新生内膜覆盖。胎盘附着部位全部修复需至产后6周（D对BCE错）。